是上肢的浅静脉的为
A. 内眦静脉
B. 头静脉
C. 奇静脉
D. 附脐静脉
E. 大隐静脉

正确答案：B。头静脉

解析：头静脉（B对）、贵要静脉、肘正中静脉及其属支为上肢的浅静脉。